本身无药理活性，在生物体内转化为活性的药物是
A. 前药
B. 生物电子等排
C. 代谢拮抗
D. 硬药
E. 软药

正确答案：A。前药

解析：本题考查前药。本身无药理活性，在生物体内转化为活性的药物是前药（A对）。前药是指一些在体外活性较小或者无活性的化合物，在体内经过酶的催化或者非酶作用，释放出活性物质从而发挥其药理作用的化合物，其常常指将活性药物（原药）与某种无毒性化合物以共价键相连接而生成的新化学实体。生物电子等排体（B错）是具有相似的分子形状和体积、相似的电荷分布，并由此表现出相似的物理性质（如疏水性），对同一靶标产生相似或拮抗的生物活性的分子或基团。代谢拮抗（C错）指设计与生物体内基本代谢物的结构有某种程度相似的化合物，使与基本代谢物竞争或干扰基本代谢物的被利用，或渗入生物大分子的合成之中形成伪生物大分子，导致致死合成，从而影响细胞的生长。硬药（D错）是指具有发挥药物作用所必需的结构特征的化合物。软药（E错）是指容易代谢失活的药物，是药物在完场治疗作用后，按预先规定的代谢途径和可以控制的速率分解，失活并迅速排出体外，从而避免药物的蓄积毒性。